个体不断发育，与恋爱、婚姻观等有密切关系的时期是
A. 成年期
B. 青年期、成年期
C. 少年期
D. 儿童期
E. 以上都不是

正确答案：B。青年期、成年期

解析：青少年在与异性的接触过程中，不断地形成、修正着恋爱观、婚姻观等重要的性观念。青春期后进入成年期，对性问题有了比较系统和稳定的认识和态度，性观念已基本形成，这是性观念的稳定期。掌握“不同年龄阶段心理卫生”知识点。